与能量代谢有关的一组维生素是
A. 维生素B₁、维生素B₂和维生素C
B. 维生素B₁、维生素B₂和烟酸
C. 维生素B₁、维生素B₆和维生素C
D. 维生素B₂、维生素B₁₂和叶酸
E. 维生素B₁、叶酸和维生素B₂

正确答案：B。维生素B₁、维生素B₂和烟酸